肾上腺素需要检查的特殊杂质是
A. 游离水杨酸
B. 酮体
C. 游离肼
D. 光降解产物
E. 二苯酮衍生物

正确答案：B。酮体

解析：本题考查药物中杂质的检查。肾上腺素需要检查的特殊杂质是酮体（B对）。肾上腺素等苯乙胺类拟肾上腺素药物，其生产过程均存在酮体氢化还原制备工艺。若氢化过程不完全，易引入酮体杂质，因其在特定波长处具有显著吸收，所以检查时可使用紫外-可见分光光度法。游离水杨酸（A错）为阿司匹林需要检查的特殊杂质。游离肼（C错）为异烟肼需要检查的特殊杂质。光降解产物（D错）为硝苯地平需要检查的特殊杂质。二苯酮衍生物（E错）为地西泮需要检查的特殊杂质。